下列关于高能磷酸键的说法，错误的是
A. 高能磷酸键能够储存生物氧化过程中释放大约40%的能量
B. 高能磷酸键水解时释放能量大于21KJ/mol
C. 书中常用“～P”符号表示
D. 含有高能磷酸键的化合物称之为高能磷酸化合物
E. ADP的高能磷酸键释放能量以后变成了ATP

正确答案：E。ADP的高能磷酸键释放能量以后变成了ATP

解析：生物氧化过程中释放的能量大约有40%以化学能的形式存储于一些特殊的有机磷酸化合物中，这些化合物水解时释放能量较多（大于21KJ/mol），称为高能磷酸键。书中常用“～P”符号表示。含有高能磷酸键的化合物称为高能磷酸化合物。掌握“ATP”知识点。